不适宜用吴茱萸汤治疗的病证是
A. 胃中虚冷，症见食谷欲呕者
B. 肝寒上逆，症见头痛干呕吐涎沫者
C. 肾阳不足，寒气内甚，症见吐利手足逆冷者
D. 肝寒犯胃，症见脘腹冷痛呕吐酸水者
E. 脾胃阳虚，阴寒上乘，症见胸满而痛，甚至胸痛彻背者

正确答案：E。脾胃阳虚，阴寒上乘，症见胸满而痛，甚至胸痛彻背者

解析：吴茱萸汤方含吴茱萸、人参、大枣、生姜。“食谷欲呕”，多是由胃寒，胃失和降所致，故当予以温胃散寒；“头痛”（尤以巅顶痛甚），干呕吐涎沫""脘腹冷痛呕吐酸水"，多由厥阴肝经寒盛，并上逆犯胃所致，故当予以温肝、和胃；“吐利，手足厥冷”，此为少阴证，即肾经阴寒内盛，伤及肾阳，阳气不能达于四末，则手足厥冷，寒邪上逆犯胃，则呕，阳失温煦，寒湿下侵，则利，故当予以温肾散寒。吴茱萸汤中以吴茱萸为君，其性辛苦热，入肝、肾、胃经，下可暖肝肾；重用生姜为臣，可温中散寒，和胃降逆；人参、大枣以补脾益气，诸药共奏温肝肾胃、补虚、降逆、止呕（ABCD对，E错为本题正确答案）。